一剂中药的总煎出量一般应为
A. 100～200ml
B. 200～300ml
C. 300～400ml
D. 500～600ml
E. 800～1000ml

正确答案：D。500～600ml

解析：本题考查的是煎药程序。一剂中药的总煎出量一般应为500～600ml（D对）。每剂药的总煎出量为成人400～600ml，儿童100～300ml。